对于老年人的口腔检查，最优的时间为
A. 每半年一次
B. 每年一次
C. 每两年一次
D. 每五年一次
E. 不用检查

正确答案：A。每半年一次

解析：对于老年人的口腔检查最好半年一次，一般至少也应1年检查一次，发现问题，及时治疗处理。掌握“老年人口腔保健”知识点。